烟酸缺乏时，可能出现
A. 口腔-生殖综合征
B. “3D”症状
C. 再障
D. 巨幼红细胞性贫血
E. 佝偻病

正确答案：B。“3D”症状